下列哪种情况肯定需要拔牙
A. 残根但根周情况良好
B. 晚期牙周炎患牙，极度松动
C. 外伤脱位牙就诊及时
D. 滞留乳牙下方恒牙先天缺失
E. 骨折累及的牙

正确答案：B。晚期牙周炎患牙，极度松动

解析：本题考查牙拔除术的适应证。晚期牙周炎患牙，极度松动（B对）肯定需要拔牙。随着口腔医学发展，拔牙适应证也发生了变化，要慎重决定是否拔牙。①牙体病损：牙冠破坏严重而牙根经治疗后可用桩核、根帽等方式利用即残根但根周情况良好应尽力保留（A错）。牙体组织龋坏或破坏严重、用现有的修复手段已无法恢复和利用者可拔除。②牙周病：晚期牙周炎患牙，极度松动，采用常规和手术治疗已无法取得牙的稳固和功能，应拔除。③牙外伤：外伤脱位牙就诊及时，牙体组织基本完整者，应复位保留（C错）。④滞留乳牙：影响恒牙萌出者应当拔除，但如滞留乳牙下方恒牙先天缺失，可暂保留（D错）。⑤骨折：骨折累及的牙，应根据牙本身的情况决定，尽可能保留（E错）。